符合书写要求的主诉是
A. 寒战高热咳嗽右胸痛两天
B. 风心病5年
C. 2年前开始多饮多食多尿
D. 已患高血压3年
E. 因慢性腹泻全身乏力1个月

正确答案：A。寒战高热咳嗽右胸痛两天

解析：符合书写要求的主诉是寒战高热咳嗽右胸痛两天，主诉是患者感受最主要的、最痛苦或最明显的症状或体征，也就是本次就诊最主要的原因及持续的时间（A对）。